下列各项，与牙齿干燥如枯骨关系最密切的是
A. 热盛伤津
B. 阳明热盛
C. 胃阴不足
D. 肾阴枯涸
E. 肺阴亏虚

正确答案：D。肾阴枯涸

解析：牙齿干燥如枯骨为肾阴枯涸（D对）。热盛伤津可见牙齿黄而干燥（A错）。阳明热盛可见牙齿光燥如石（B错）。胃阴不足可见牙齿干燥，牙龈萎缩，牙根暴露，牙齿松动（C错）。肺阴亏虚可见口燥咽干（E错）。